下列何者不属于小网膜内的结构
A. 胃左、右动脉
B. 肝固有动脉
C. 胆总管
D. 胃网膜左、右动脉
E. 无

正确答案：D。胃网膜左、右动脉

解析：胆总管（C对）、肝固有动脉（B对）及肝门静脉在肝十二指肠韧带内走行，属于小网膜内的结构，胃左、右动脉（A对）在肝胃韧带两层之间走行，属于小网膜内的结构，胃网膜左、右动脉（D错，为本题正确答案）在大网膜前两层腹膜间走行。